荆防颗粒的功能是
A. 解表散寒，祛风胜湿
B. 疏风散寒，解表清热
C. 疏风解表，清热解毒
D. 解肌发表，调和营卫
E. 疏风清热，宣肺止咳

正确答案：A。解表散寒，祛风胜湿

解析：本题考查的是荆防颗粒的功能。荆防颗粒的功能是解表散寒，祛风胜湿（A对）。荆防颗粒：【功能】解表散寒，祛风胜湿。疏风散寒，感冒清热颗粒：【功能】疏风散寒，解表清热（B错）。银翘解毒丸：【功能】疏风解表，清热解毒（C错）。桂枝合剂：【功能】解肌发表，调和营卫（D错）。桑菊感冒片：【功能】疏风清热，宣肺止咳（E错）。